在全球烟草制品中占据最大份额的是哪种形式的烟草
A. 手卷烟草
B. 机制卷烟
C. 水烟
D. 无烟烟草
E. 电子香烟

正确答案：B。机制卷烟

解析：有烟烟草使用是指通过点燃产生烟气的烟草植物干叶或烟熏叶子。其中，机制卷烟在全球烟草制品中占据最大份额。掌握“干预基本模式及烟草行为干预”知识点。